对诊断小儿支气管哮喘最有意义的肺部特征是
A. 双肺呼吸音增粗
B. 右肺中湿啰音，随体位改变
C. 两肺满布哮鸣音，呼气延长
D. 双肺呼吸音减弱
E. 双下肺中细湿啰音

正确答案：C。两肺满布哮鸣音，呼气延长

解析：哮鸣音是哮喘诊断最有意义的肺部特征常于夜间或清晨加重。发作前可有流涕、打喷嚏和胸闷，发作时呼吸困难，呼气相延长伴有喘鸣声（C对）。严重病例呈端坐呼吸，恐惧不安，大汗淋漓，面色青灰。体格检查可见桶状胸、三凹征，肺部满布哮鸣音，严重者气道广泛堵塞，哮鸣音反可消失。双肺呼吸音粗往往提示支气管粘膜有水肿或者炎症浸润，造成不光滑或者狭窄，使气流进出不畅，形成粗糙的呼吸音（A错）。肺部湿罗音随体位改变常见于急性左心衰，肺气肿等疾病（B错）。双肺呼吸音减弱是临床上很多疾病都会出现的一种现象。如慢性阻塞性肺疾病、肺间质纤维化、心力衰竭等（D错）。双下肺中细湿啰音发生于小支气管的湿啰音。在吸气后期出现，见于细支气管炎、支气管肺炎、肺淤血、肺水肿和肺梗死等（E错）。